牙周探诊最重要的诊断意义是
A. 附着丧失比袋深更有意义
B. 袋越深，表明牙周病越重
C. 牙周病的程度与龈缘的位置有关
D. 牙龈出血是牙龈炎症的表现
E. 袋内溢脓是牙周炎症加重的体征

正确答案：A。附着丧失比袋深更有意义

解析：本题考查牙周探诊的目的。牙周探诊最重要的诊断意义是附着丧失比袋深更有意义（A对）。牙周探诊是牙周病特别是牙周炎的诊断中最重要的检查方法。袋的深度是从龈缘到袋底的距离，牙龈向冠方肿胀增生也会使袋深度增加，但若没有附着丧失，对于牙周病是没有意义的（B错）。牙周病的严重程度与牙周袋的深度和牙槽骨的吸收有关系，对应的牙周袋的深度与附着丧失即结合上皮的位置有关（C错）。牙周袋加深，牙槽骨进行性吸收是牙周炎症加重的表现（E错），袋内溢脓提示有化脓性炎症，与炎症程度无关。牙周探诊时牙龈出血（D错）表示牙龈有炎症，但是对于牙周探诊来说，只有获得附着水平才能反映出实际附着丧失的情况，对牙周疾病最具诊断意义。